药物代谢是机体对药物的处置过程，下列关于药物代谢的说法，正确的有
A. 非甾体抗炎药舒林酸结构中的甲基亚砜，经还原后的代谢物才具有活性
B. 抗抑郁药丙米嗪结构中的二甲胺片段，经N-脱甲基后的代谢物失去活性
C. 驱虫药阿苯达唑结构中的丙硫醚，经S-氧化后的代谢物才具有活性
D. 抗癫痫药苯妥英钠结构中的一个芳环，发生氧化代谢后产生羟基化的代谢物仍具有活性
E. 解热镇痛药保泰松结构中的一个芳环，发生氧化代谢后产生羟基化的保泰松仍具有活性

正确答案：A、C、E。非甾体抗炎药舒林酸结构中的甲基亚砜，经还原后的代谢物才具有活性；驱虫药阿苯达唑结构中的丙硫醚，经S-氧化后的代谢物才具有活性；解热镇痛药保泰松结构中的一个芳环，发生氧化代谢后产生羟基化的保泰松仍具有活性

解析：本题考查药物代谢。非甾体抗炎药舒林酸结构中的甲基亚砜，经还原后的代谢物才具有活性（A对）。驱虫药阿苯达唑结构中的丙硫醚，经S-氧化后的代谢物才具有活性（C对）。解热镇痛药保泰松结构中的一个芳环，发生氧化代谢后产生羟基化的保泰松仍具有活性（E对）。